拔牙后牙槽窝下方颌骨内出现圆形囊性密度减低影像
A. 含牙囊肿
B. 残余囊肿
C. 正中囊肿
D. 球上颌囊肿
E. 鼻腭管囊肿

正确答案：B。残余囊肿

解析：本题考查残余囊肿。拔牙后牙槽窝下方颌骨内出现圆形囊性密度减低影像为残余囊肿（B对）。残余囊肿：在拔牙后的牙槽窝下方颌骨内出现圆形囊性密度减低影像。